下列临床科研成果应用的道德要求中不包括
A. 不谋私利，以人民利益为重
B. 立志献身医学科研工作
C. 科研成果应用为社会负责
D. 科研成果应用增加经济效益
E. 科研成果应用对全人类负责

正确答案：D。科研成果应用增加经济效益

解析：临床科研成果应用的道德要求不包括科研成果应用增加经济效益（D错，为本题正确答案）。作为科研人员，必须遵循医学科研道德的要求，自觉加强科研诚信建设，只有这样才能在探求生命运动和疾病发生、发展规律中找出保障人类健康、战胜疾病的有效方法和途径（A对）。医学科研的目标是繁荣医学，造福人类（BCE对）。